引起夜盲症、皮肤干燥是由于缺乏
A. 维生素A
B. 维生素B1
C. 维生素C
D. 维生素D
E. 维生素E

正确答案：A。维生素A

解析：缺乏维生素A，可引起夜盲症、眼干燥症、皮肤干燥和毛囊丘疹等。掌握“脂溶性维生素”知识点。